冬季，某居民在家用煤气热水器洗澡时晕倒，口唇黏膜呈樱桃红色，引起该症状最可能的气体是
A. CO
B. CO₂
C. NH₃
D. SO2
E. NO

正确答案：A。CO

解析：患者使用煤气热水器洗澡（日常生活中CO中毒的常见原因）后晕倒，口唇呈樱桃红色，其最可能的诊断是一氧化碳中毒（A对）。Hb与CO结合后呈樱桃色。